下列各项，属传染性单核细胞增多症临床特点的是
A. 白细胞明显升高
B. 单核细胞明显降低
C. 单核细胞明显升高
D. 肝脾缩小
E. 异形淋巴细胞增多

正确答案：E。异形淋巴细胞增多

解析：传染性单核细胞增多症是主要由EB病毒原发感染所指的急性疾病。早期白细胞总数可正常或偏低，以后逐渐升高，异性淋巴细胞增多可达10%-30%（E对），其超过10%或绝对数超过1.0×109，具有诊断价值。